下列哪种因素与牙体缺损的成因无关
A. 楔状缺损
B. 重度磨耗
C. 牙周病
D. 牙外伤
E. 龋病

正确答案：C。牙周病

解析：本题考查牙体缺损的病因。牙周病不会导致牙体缺损，可以造成牙松动（C错，为本题正确答案）。楔状缺损为牙颈部的缺损（A对）。重度磨耗为牙齿咬合面和邻面由于咀嚼作用而发生的均衡的生理性的硬组织丧失（B对）。龋病以细菌为主的多种因素下牙体硬组织的慢性进行性破坏（E对）。牙外伤可使牙体外形缺损（D对）。